乳磨牙的窝沟龋常见的年龄段为
A. 1～2岁
B. 2～3岁
C. 3～5岁
D. 5～6岁
E. 6～7岁

正确答案：C。3～5岁

解析：3～5岁多见乳磨牙的窝沟龋，与牙齿初萌有关。掌握“龋病的临床表现与分类”知识点。